甲状腺激素不具哪项药理作用
A. 维持生长发育
B. 增强心脏对儿茶酚胺的敏感性
C. 维持血液系统功能正常
D. 维持神经系统功能
E. 促进代谢

正确答案：C。维持血液系统功能正常